药用罂粟壳
A. 只能在医疗单位配方使用
B. 只能在医药商店零售
C. 在省级新特药商店配方、销售
D. 由医药商店凭盖有医疗单位公章的医生处方配方
E. 在百货商厦、超市等销售

正确答案：D。由医药商店凭盖有医疗单位公章的医生处方配方

解析：本题药用罂粟壳。药用罂粟壳由医药商店凭盖有医疗单位公章的医生处方配方（D对）。《条例》规定，麻醉药品目录中的罂粟壳只能用于中药饮片和中成药的生产以及医疗配方使用。